下列关于乳汁形成与分泌的机制的叙述，错误的是
A. 雌激素促进乳腺管发育，孕激素刺激乳腺腺泡发育
B. 大量雌激素抑制乳汁生成
C. 雌激素在产后是促使乳汁排出的主要激素
D. 胎盘生乳素促进乳汁生成
E. 催乳素是产后促使乳汁排出的主要激素

正确答案：C。雌激素在产后是促使乳汁排出的主要激素

解析：催乳素是产后促使乳汁排出的主要激素（C错，为本题正确答案）。胎盘分泌大量雌激素和孕激素，前者刺激乳腺腺管发育，后者刺激乳腺腺泡发育（A对）。妊娠期间虽有大量的多种激素参与乳腺发育，做好泌乳准备，但妊娠期间并无乳汁分泌，与大量雌、孕激素抑制乳汁生成有关（B对）。胎盘生乳素可以促进乳腺腺泡发育，刺激乳腺上级细胞合成乳白蛋白、乳酪蛋白和乳珠蛋白，为产后泌乳作准备（D对）。催乳素的主要生理功能是维系产后泌乳（E对），同时还与卵巢激素共同作用促进分娩前乳房导管和腺体的发育。